硫柳汞在醋酸可的松混悬型注射液处方中的作用是
A. 渗透压调节剂
B. 抑菌剂
C. 助悬剂
D. 润湿剂
E. 抗氧剂

正确答案：B。抑菌剂

解析：本题考查注射剂常用的附加剂。硫柳汞为抑菌剂（B对）；在处方中，醋酸可的松微晶为主药；硫柳汞为抑菌剂；氯化钠为渗透压调节剂（A错）；羧甲基纤维素钠为助悬剂（C错）；聚山梨酯80为润湿剂（D错）；无抗氧剂（E错）。